下列有关桥体应具备的条件，说法正确的是
A. 材料性能
B. 自洁作用
C. 形态和色泽
D. 恢复缺失牙功能
E. 以上均正确

正确答案：E。以上均正确

解析：桥体应具备的条件：①恢复缺失牙功能。②自洁作用。③形态和色泽。④减轻（牙合）力。⑤材料性能。掌握“固定桥的设计”知识点。